供体菌通过性菌毛将遗传物质转移给受体菌，称为
A. 转化
B. 转导
C. 溶原性转换
D. 接合
E. 原生质体融合

正确答案：D。接合